2006年某地区育龄妇女有100万，孕产妇死亡40例。计算该地区孕产妇死亡率需要收集的数据是
A. 该地区孕产妇数
B. 该地区分娩数
C. 该地区活产数
D. 该地区孕产妇建卡数
E. 该地区孕妇住院分娩数

正确答案：C。该地区活产数

解析：本题考查孕产妇死亡率。孕产妇死亡率指每10万活产数中孕产妇死亡人数，计算该地区孕产妇死亡率需要收集的数据是该地区活产数（C对ABDE错）。孕产妇死亡指妇女在妊娠期至妊娠结束后42天以内，由于任何与妊娠或妊娠处理有关的或由此而加重了的原因导致的死亡称为孕产妇死亡，但不包括意外事故死亡。计算公式：孕产妇死亡率=该年该地区孕产妇死亡人数/某年某地区活产数×10万/10万。